男，57岁，心前区疼痛2年，多于安静状态发生，近日于睡眠中突发心前区疼痛。查心电图ST段抬高，冠脉造影见一过性狭窄。予硝苯地平治疗的主要药理学依据是
A. 选择性扩张外冠状动脉，增加心肌供血
B. 显著减慢心率，降低心肌耗氧量
C. 选择性增加心内膜膜下心肌供氧
D. 显著抑制心肌收缩力，降低心肌耗氧量
E. 抑制或逆转心肌肥厚，降低心肌耗氧量

正确答案：A。选择性扩张外冠状动脉，增加心肌供血

解析：患者老年男性，心前区疼痛2年，多于安静状态发生（变异型心绞痛常见症状），近日于睡眠中突发心前区疼痛。检查：心电图ST段抬高（变异型心绞痛特异性心电图表现），冠脉造影见一过性狭窄（变异型心绞痛发病机制，并排除器质性冠脉病变引起的静息型心绞痛），结合症状和检查可诊断为变异型心绞痛。由于冠脉痉挛导致心肌缺血缺氧，首选钙通道阻滞剂扩张冠状血管，特别是处于痉挛状态的血管有显著的解除痉挛作用（A对），从而增加心肌供血。钙通道阻滞剂的抑制心肌作用较弱，特别是硝苯地平还具有较强的扩张外周血管，降低外周阻力且血压下降后反射性加强心肌收缩力（BDE错），可部分抵消对心肌的抑制作用，因而较少诱发心衰，但无逆转心肌肥厚的作用（E错）和选择性增加心内膜膜下心肌供氧的作用（C错）。